三角肌的止点
A. 臀肌粗隆
B. 肩峰
C. 尺骨鹰嘴
D. 三角肌粗隆
E. 无

正确答案：D。三角肌粗隆

解析：三角肌的止点是三角肌粗隆（D对）。